龈下刮治器刮除牙石时，工作端与牙面之间的角度是
A. ＜45°
B. 60°
C. 80°
D. 90°
E. 105°

正确答案：C。80°

解析：本题考查龈下刮治术。龈下刮治器刮除牙石时，工作端与牙面之间的角度是80°（C对）。用Gracey刮治器应认清工作刃，长而凸的外侧切刃缘是工作刃缘，匙形器放入牙周袋时应使工作端的平面与牙根面平行，到达袋底后，与根面间逐渐成45°角，以探查根面牙石，探到牙石根方后，随即与牙面形成约80°角进行刮治。在使用过程中只需将工作端露在牙周袋外面的部分与牙齿长轴平行，则其刃缘即与牙根面成80°角左右，使刮治技术能较为顺利地进行。操作完成后，仍回到与根面平行的位置，取出器械。